细菌性肝脓肿的主要治疗是
A. 抗生素治疗
B. 穿刺抽脓，脓腔注入抗生素
C. 切开引流
D. 理疗
E. 内引流术

正确答案：A。抗生素治疗

解析：细菌性肝脓肿属细菌感染性疾病，抗生素治疗（A对）是其主要治疗方式。穿刺抽脓，脓腔注入抗生素（B错）适用于单个较大脓肿。切开引流（C错）适用于有穿破可能或已穿破的脓肿。理疗（D错）临床较少用到。细菌性肝脓肿不适用内引流术（E错），会引起继发感染，加重病情。